贫血是外周血单位体积中
A. 红细胞数低于正常低限
B. 血细胞比容低于正常低限
C. 红细胞数及血细胞比容低于正常低限
D. 红细胞数，血红蛋白和血细胞比容低于正常低限
E. 循环血量较正常者减少

正确答案：D。红细胞数，血红蛋白和血细胞比容低于正常低限

解析：贫血是指外周血液在单位体积中的血红蛋白浓度、红细胞计数和（或）血细胞比容低于正常低限，以血红蛋白浓度较为重要。掌握“贫血概论及缺铁性贫血”知识点。